口腔科医生受感染的途径中没有
A. 器械刺伤皮肤
B. 操作后不洗手
C. 空气消毒不严
D. 食物消毒不严
E. 接触病人血液和唾液

正确答案：D。食物消毒不严

解析：口腔医务人员被感染主要可能发生于：①直接接触受感染的血及分泌物或感染性病损；②接触含有感染病原的飞沫微滴；③接触受污染的没有适当消毒的尖锐器械的边缘。食物不能进行传播。掌握“口腔医疗保健中的感染”知识点。